急性龈乳头炎的病因如下，除了
A. 过强的冷热刺激
B. 过硬、过锐的食物刺伤
C. 不恰当剔牙
D. 食物嵌塞
E. 充填体悬突，不良修复体边缘

正确答案：A。过强的冷热刺激

解析：牙龈乳头受到机械或化学的刺激，是引起急性龈乳头炎的直接原因。食物嵌塞造成牙龈乳头的压迫及食物发酵产物的刺激可引起龈乳头的急性炎症。不适当的使用牙签或其他器具剔牙，过硬、过锐的食物的刺伤，邻面龋尖锐边缘的刺激也可引起急性龈乳头炎。充填体的悬突、不良修复体的边缘、义齿的卡环臂尖以及不良的松牙固定等均可刺激龈乳头，造成龈乳头的急性炎症。掌握“急性龈乳头炎”知识点。